前磨牙中体积最小的牙齿为
A. 上颌第一前磨牙
B. 下颌第一前磨牙
C. 上颌第二前磨牙
D. 下颌第二前磨牙
E. 上颌中切牙

正确答案：B。下颌第一前磨牙

解析：下颌第一前磨牙是前磨牙中体积最小的牙齿。牙冠显得较方圆。掌握“上下颌前磨牙的外形及临床应用解剖”知识点。